女，11个月，2个月前因“睡眠不安，头部多汗，方颅”就诊，用维生素D及钙剂正规治疗2个月，症状好转，此时腕骨X线表现是
A. 临时钙化带模糊
B. 长骨弯曲畸形，骨骺线正常
C. 临时钙化带致密增厚
D. 长骨短粗和弯曲，干骺端变宽呈杯口状
E. 临时钙化带消失

正确答案：C。临时钙化带致密增厚

解析：女，11个月，2个月前因"睡眠不安，头部多汗，方颅就诊（佝偻病活动期表现），故患者考虑诊断为营养性维生素D缺乏，此时用维生素D及钙剂正规治疗2个月，症状好转，处于营养性维生素D缺乏恢复期，其腕骨X线表现是临时钙化带致密増厚（C对）。临时钙化带模糊（A错）、是营养性维生素D缺乏早期的表现。长骨弯曲畸形，骨骺线正常（B错）、长骨短粗和弯曲，干骺端变宽呈杯口状（D错）、临时钙化帯消失（E错）是营养性维生素D缺乏激期表现。